细菌通过合成代谢不断合成菌体成分，下列选项中属于细菌的合成性代谢产物的是
A. 色素
B. 细菌素
C. 热原质
D. 维生素
E. 以上均是

正确答案：E。以上均是

解析：细菌通过合成代谢不断合成菌体成分，此外，还合成许多在医学上具有重要意义的代谢产物，如热原质、毒素（包括内毒素和外毒素）、侵袭性酶、色素、细菌素、抗生素和维生素等，前3种是细菌的致病物质，与细菌的致病性有关。掌握“细菌的生理”知识点。